不属于氯丙嗪临床应用的选项是
A. 精神分裂症
B. 感染中毒性精神病
C. 顽固性呃逆
D. 洋地黄引起的呕吐
E. 前庭刺激所致晕动症

正确答案：E。前庭刺激所致晕动症

解析：氯丙嗪临床应用包括1.精神分裂症（A对）：主要用于Ⅰ型精神分裂症，对各种器质性精神病（如脑动脉硬化性精神病、感染中毒性精神病）（B对）和症状性精神病的兴奋、幻觉和妄想症状也有效；2.顽固性呃逆（C对）、多种疾病和药物（如洋地黄）引起的呕吐（D对）；3.低温麻醉和人工冬眠。前庭刺激所致晕动症（E错，为本题正确答案）氯丙嗪治疗无效，可用东莨菪碱等治疗。